下述哪一项属于概率抽样方法
A. 偶遇抽样
B. 立意抽样
C. 系统抽样
D. 雪球抽样
E. 判断抽样

正确答案：C。系统抽样

解析：本题考查概率抽样的方法。概率抽样的方法有单纯随机抽样、分层抽样、系统抽样（C对）、整群抽样等。偶遇抽样（A错）、立意抽样（C错）、雪球抽样（D错）、判断抽样（E错）均属于非概率抽样。